男，72岁。胃大部切除毕I式吻合术后6天。有肛门排气后开始进流质物质饮食，进食后腹胀并呕吐，呕吐物中含胆汁。查体：心肺未见明显异常，腹部可见胃型，无蠕动波。腹部X线片示残胃内大量液体潴留。最可能的原因是
A. 残胃蠕动功能障碍
B. 吻合口不全梗阻
C. 吻合口水肿
D. 近端空肠逆流
E. 远端空肠梗阻

正确答案：A。残胃蠕动功能障碍

解析：老年男性患者，胃大部切除毕I式吻合术（胃残端直接与十二指肠残端吻合）后6天。有肛门排气后开始进流质物质饮食（饮食改变），进食后腹胀并呕吐，呕吐物中含胆汁（胃瘫的典型表现）。查体：心肺未见明显异常，腹部可见胃型，无蠕动波（提示胃瘫）。腹部X线片示残胃内大量液体潴留，综合该患者的临床表现、辅助检查，该患者的诊断考虑为残胃蠕动功能障碍。残胃蠕动功能障碍（胃瘫），（三版八年制外科学P469）多见于术后4-10日，临床上表现为上腹部饱胀，呕吐含胆汁胃内容物，X线造影检查可见胃扩张，胃潴留而无蠕动（A对）；吻合口不全梗阻多见于吻合口过小或吻合时内翻过多，加上术后吻合口水肿所致，但胃蠕动功能不受影响，仍可见到胃蠕动（BC错）；近端空肠逆流可见于毕Ⅱ式胃大部切除术（D错），为防止这种情况吻合口近端空肠位置必须高于远端空肠。